脊神经
A. 由前、后根在椎管内合成
B. 脊膜支经椎孔返回椎管
C. 后支仅含有感觉纤维
D. 前支均相互交织成丛
E. 借交通支与交感干相连

正确答案：E。借交通支与交感干相连

解析：脊神经由前根和后根在椎间孔处合成（A错）。脊膜支为脊神经出椎间孔后发出的一条返回椎管内的细支（B错）。后支为混合性神经支（C错）。除12对胸神经外，其余脊神经前支形成4个神经丛，即颈丛、臂丛、腰丛和骶丛。由这些神经丛发出神经分支分布于身体的效应器和感受器。（D错）。交通支属于交感神经系统的结构，为连于脊神经与交感干之间的细支（E对）。